血液中哪种激素出现高峰可以作为排卵的标志
A. 雌激素
B. 孕激素
C. 黄体生成素
D. 卵泡刺激素
E. 卵泡刺激素释放激素

正确答案：C。黄体生成素